在哪种情况下，机体为正氮平衡
A. 饥饿
B. 进食低质量蛋白
C. 摄入氮﹥排出氮
D. 糖尿病
E. 摄入氮﹤排出氮

正确答案：C。摄入氮﹥排出氮